具有抗衰老作用的营养素是
A. 乳糖
B. 维生素C
C. 膳食纤维
D. 维生素E
E. 硒

正确答案：D。维生素E